患者，女，51岁，体检时发现血160/105mmHg，量试验餐后2小时血糖为9.56mmol/L（参考范围＜7.8mmol/L），甘油三酯0.52mmol/L（参考范围0.56～1.70mmol/L），总胆固醇6.26mmol/L（参考范围＜0.2mmoL），低密度脂蛋白胆固醇4.85mmol/L（参考范围2.1～3.1mmol/L），高密度脂蛋白胆固醇1.20mmol/L（参考范围1.2～1.65mmol/L，肌酐60㎛ol/L（参考范围45～84㎛ol/M），蛋白尿：++。临床诊断为高血压病、高脂血症、糖耐量异常。对该患者的健康教育的说法，错误的是
A. 控制体重
B. 不必限盐
C. 适当运动
D. 减少脂肪摄入
E. 戒烟限酒

正确答案：B。不必限盐

解析：本题考查高血压患者的健康教育。高血压患者的健康教育包括：①控制体重；②限盐摄入（B错，为本题正确答案）；③补充钾盐；④减少脂肪摄入；⑤戒烟少酒；⑥增加运动；⑦减轻精神压力，保持心态平衡等。